莲须的药用部位是
A. 花蕾
B. 花粉粒
C. 柱头
D. 雄蕊
E. 花柱

正确答案：D。雄蕊

解析：本题考查的是花类药材的药用部位。莲须的药用部位是雄蕊（D对）。药用部位为完整的花、花序或花的某一部分，这类中药称花类中药。完整的花有的是已开放的，如洋金花、红花；有的是尚未开放的花蕾（A错），如丁香、金银花。药用花序亦有的是采收未开放的，如款冬花；有的要采收已开放的，如菊花、旋覆花。而夏枯草实际上采收的是带花的果穗。药用仅为花的某一部分，如西红花系柱头（C错），莲须系雄蕊，玉米须系花柱（E错），松花粉、蒲黄等则为花粉粒（B错）等。